能作为应激原的是
A. 噪声
B. 心律失常
C. 精神性因素
D. 器官功能紊乱
E. 以上都是

正确答案：E。以上都是

解析：噪声（A对）、心律失常（B对）、精神性因素（C对）和器官功能紊乱（D对，故E为本题正确答案）都能作为应激原。